小儿时期患结核病最常见的类型为
A. 原发型肺结核
B. 结核性胸膜炎
C. 粟粒性肺结核
D. 结核性脑膜炎
E. 结核性腹膜炎

正确答案：A。原发型肺结核